下列视诊的顺序描述正确的一项是
A. 右上→左上→左下→右下
B. 右上→左下→左上→右下
C. 左上→右上→左下→右下
D. 右上→右下→左下→左上
E. 左上→右上→右下→左下

正确答案：A。右上→左上→左下→右下

解析：视诊的方法：首先检查主诉部位，因为这是患者最关心的问题。然后再按一定顺序（如右上→左上→左下→右下）检查其他部位。掌握“牙髓病检查方法及诊断程序”知识点。